肾上腺素的禁忌证包括
A. 冠状动脉粥样硬化
B. 甲状腺机能亢进
C. 高血压
D. 器质性心脏病
E. 哮喘

正确答案：A、B、C、D。冠状动脉粥样硬化；甲状腺机能亢进；高血压；器质性心脏病